易发生持续干咳不良反应的药品是
A. 氢氯噻嗪
B. 硝苯地平
C. 福辛普利
D. 硝酸甘油
E. 利血平

正确答案：C。福辛普利

解析：本题考查福辛普利的不良反应。福辛普利（C对）典型不良反应包括：持续干咳（发生率约20%）、胸痛、上呼吸道症状（鼻炎）、血肌酐和尿素氮及蛋白尿高、血管神经性水肿、味觉障碍（有金属味）。